青少年配镜的基本原则是
A. 充分矫正，以佩戴后获得正常视力的适度凹透镜为宜
B. 不充分矫正，以佩戴后获得较好视力的低度凹透镜为宜
C. 充分矫正，以佩戴后获得正常视力的适度凸透镜为宜
D. 不充分矫正，以佩戴后获得较好视力的低度凸透镜为宜
E. 不充分矫正，以佩戴后获得正常视力的凹透镜为宜

正确答案：B。不充分矫正，以佩戴后获得较好视力的低度凹透镜为宜